可用于治疗绝经期后晚期乳腺癌的药物是
A. 雌二醇
B. 他莫昔芬
C. 甲地孕酮
D. 米非司酮
E. 二甲双胍

正确答案：B。他莫昔芬

解析：本题考查他莫昔芬。他莫昔芬（B对）用于治疗乳腺癌（ER阳性者，绝经前、后均可用）、化疗无效的晚期卵巢癌和晚期子宫内膜癌。雌二醇（A错）用于卵巢功能不全或卵巢激素不足引起的各种症状。甲地孕酮（C错）用于治疗不孕症、先兆性流产及习惯性流产。米非司酮（D错）为紧急避孕药。二甲双胍（E错）首选用于单纯饮食控制及体育锻炼治疗无效的2型糖尿病，特别是肥胖的2型糖尿病。